哪个硬脑膜窦与面部静脉交通
A. 上矢状窦
B. 下矢状窦
C. 横窦
D. 乙状窦
E. 海绵窦

正确答案：E。海绵窦

解析：海绵窦（E对）与周围的静脉有广泛的交通和联系，向前借眼静脉与面静脉交通，向下经卵圆孔的小静脉与翼静脉丛相通，故面部感染可经上述交通蔓延至海绵窦，引起海绵窦炎和血栓形成。